男，40岁。发现血尿、蛋白尿5年。查体：BP150/90mmHg，24小时尿蛋白定量1.0～1.7g，血肌酐100μmol/L。首先考虑的临床诊断是
A. 肾血管性高血压
B. 慢性肾炎
C. 隐匿性肾炎
D. 高血压肾损害
E. 肾病综合征

正确答案：B。慢性肾炎

解析：患者发现血尿蛋白尿5年，查体发现1级高血压（轻度），尿蛋白1.0～1.7g（正常值小于150mg/d），血肌酐值100μmol/L【正常值（男）44～133μmol/L】，以上症状和检查符合慢性肾炎的症状和实验室检查，因此首选诊断应为慢性肾炎（B对）。肾血管性高血压（A错）一般会出现进展迅速和突然出现的高血压，上腹部或肋脊角处一般闻及杂音，本患者未表现这些症状，（P259），故不作为首选诊断。隐匿性肾炎（C错）临床上一般只表现为蛋白尿和血尿，一般无水肿、高血压和肾功能损害，患者出现明显高血压，不符合隐匿型肾炎的典型症状（P477），所以不作为首选诊断。高血压肾损害（D错）高血压一般出现于肾功能损害之前数十年，常以夜尿增多为首发症状，不会出现血尿蛋白尿，患者已出现长期明显血尿蛋白尿，与高血压肾损害典型症状不符，因此不作为首选诊断。肾病综合征（E错）必需诊断标准是尿蛋白大于3.5g/d和血浆白蛋白低于30g/L，患者尿蛋白1.0～1.7g/d（P470），不符合诊断标准，故不作为首选诊断。